在锻造18-8铬镍不锈钢中不属于镍的作用的是
A. 抗腐蚀性
B. 增强合金的强度
C. 作为溶剂元素
D. 增强合金韧性
E. 增加合金的延展性

正确答案：C。作为溶剂元素

解析：本题考查锻造18-8铬镍不锈钢中镍的作用。在锻造18-8铬镍不锈钢中，铬作为溶剂元素，可在合金表面形成致密而稳定的氧化保护膜（C错，为本题的正确答案）。镍能提高钢的耐腐蚀性能（A对），增加合金的强度（B对）、韧性（D对）和延展性（E对）。